以下情形中，可以参加执业医师资格考试的是
A. 有医学专业本科以上学历，在医疗机构中工作满1年
B. 有医学专业本科以上学历，在医疗机构中试用期满1年
C. 有医学专业本科以上学历，在医疗机构中试用期满2年
D. 有医学专业专科学历，在医疗机构中试用期满1年
E. 有医学专业专科学历，在医疗机构中工作满1年

正确答案：B。有医学专业本科以上学历，在医疗机构中试用期满1年